通过健康危险因素评价，健康类型可以划分为
A. 健康型、无病型、有病型、死亡型
B. 健康型、自创性危险因素型、难以改变的危险因素型、大量危险型
C. 健康型、存在危险型、大量危险型
D. 健康型、自创性危险因素型、难以改变的危险因素型、一般性危险型
E. E.健康型、不健康型

正确答案：D。健康型、自创性危险因素型、难以改变的危险因素型、一般性危险型